一次用药后，（）个药物消除半衰期时，可认为该药物几乎被完全消除
A. 2
B. 4
C. 5
D. 8

正确答案：C。5

解析：本题考查药物消除半衰期的相关内容。药物半衰期是指药物在体内的血药浓度从最高值下降一半所需要的时间。一次用药后，5（C对ABD错）个药物消除半衰期时，可认为该药物几乎被完全消除。